右下颌5-8缺失，余留牙正常，基牙应选
A. 43，44
B. 43，44，34
C. 43，44，34，35
D. 43，44，34，37
E. 44，34，37

正确答案：E。44，34，37

解析：此题考虑到基牙选择的要求，选44，为最近基牙，为了稳定要选其他2颗基牙，而43一般不选择，37做对侧最远基牙，而3颗基牙保持稳定，选择44对称基牙34做基牙达到平面型设计。掌握“局部义齿的设计”知识点。